描述疾病流行强度的术语有
A. 散发、流行、暴发、大流行
B. 周期性、季节性、流动性
C. 发病率、患病率、死亡率
D. 传染性、侵袭性、易感性
E. 以上均错

正确答案：A。散发、流行、暴发、大流行

解析：疾病的流行强度是指某疾病在某地区、某人群中，一定时期内发病数量的变化及各病例间联系的程度。包括散发、流行、大流行、暴发。掌握“流行病学资料与疾病分布”知识点。